苯妥英钠的消除速率与血药浓度有关。在低浓度（低于10㎍/ml）时，消除过程属于一级过程；高浓度时由于肝微粒体代谢酶能力有限，则按零级动力学消除，此时只要稍微增加剂量就可使血药浓度显著升高，易出现中毒症状。苯妥英钠在临床上的有效血药浓度范围是10～20㎍/ml。已知苯妥英钠在肝肾功能正常病人中的Km=12㎍/ml，Vm=10mg/kg·d，当每天给药剂量为3mg/（kg·d），则稳态血药浓度Css=5.1㎍/ml；当每天给药剂量为6mg/（kg·d），则稳态血药浓度Css=18㎍/ml。已知Css=（KmX₀）/（τVm-X₀）。若希望达到稳态血药浓度12㎍/ml，则病人的给药剂量是
A. 3.5mg/（kg·d）
B. 40mg/（kg·d）
C. 4.35mg/（kg·d）
D. 5.0mg/（kg·d）
E. 5.6mg/（kg·d）

正确答案：D。5.0mg/（kg·d）

解析：本题考查药动学参数的计算。由题意可知：Km=12㎍/ml，Vm=10mg/kg·d，当每天给药剂量为3mg/（kg·d）则稳态血药浓度Css=5.1㎍/ml；将其数据带入公式Css=（KmX₀）/（τVm-X₀）即得τ=1mg，若希望达到稳态血药浓度12㎍/ml，则有12=（12×X₀）/（1×10-X₀），得X₀=5.0mg/（kg·d）（D对）。